引起四季豆中毒的毒素是
A. 龙葵素
B. 皂素
C. 类秋水仙碱
D. 3-硝基丙酸
E. 肠毒素

正确答案：B。皂素